企业违反药品管理法规定，在购销药品中无真实、完整的购销记录且情节严重的，应吊销其
A. 《药品生产许可证》
B. 《药品经营许可证》
C. 《医疗机构制剂许可证》
D. 《医疗机构执业许可证》
E. 《进口准许证》

正确答案：B。《药品经营许可证》

解析：本题考查无证生产、经营药品相关的法律责任。企业违反药品管理法规定，在购销药品中无真实、完整的购销记录且情节严重的，应吊销其《药品经营许可证》（B对）。根据《中华人民共和国药品管理法》第十八条规定，药品经营企业购销药品，必须有真实完整的购销记录。购销记录必须注明药品的通用名称、剂型、规格、批号、有效期、生产厂商、购（销）货单位、购（销）货数量购销价格、购（销）货日期及国务院药品监督管理部门规定的其他内容。根据《中华人民共和国药品管理法》第84条规定，药品经营企业违反本法第十八条、第十九条规定的，责令改正，给予警告；情节严重的，吊销《药品经营许可证》。